发热机制的中心环节是
A. 产热增多
B. 散热减少
C. 体温调节机构失控
D. 支配外周血管神经障碍
E. 体温调定点上移

正确答案：E。体温调定点上移

解析：由于致热原的作用使体温调定点上移（E对）而引起调节性体温升高称为发热。产热增多（A错）、散热减少（B错）、体温调节机构失控（C错）、支配外周血管神经障碍（D错）都不是发热机制的中心环节。